关于竞争性拮抗药的说法，错误的是
A. 小剂量产生激动作用，大剂量产生拮抗作用
B. 可与激动药竞争同一受体
C. 与受体的亲和力较强，无内在活性
D. 可使激动药的量效曲线平行右移
E. 用拮抗参数（pA₂）表示拮抗强度的大小

正确答案：A。小剂量产生激动作用，大剂量产生拮抗作用

解析：本题考查竞争性拮抗药。部分激动剂是指具有一定亲和力，但内在活性低，小剂量产生激动作用，大剂量产生拮抗作用（A错，为本题正确答案）。竞争性拮抗药与受体有很高亲和力，但缺乏内在活性（α=0）（C对）。竞争性拮抗药可与激动药竞争同一受体（B对），是可逆的，可通过增加激动药的浓度使其效应恢复到原先单用激动药时的水平，使激动药的量效曲线平行右移（D对），但其最大效应不变。竞争性拮抗药与受体的亲和力可用拮抗参数（pA₂）表示（E对），pA₂值的大小反应竞争性拮抗药对其激动药的拮抗程度。